手太阴肺经分布于上肢的部位是
A. 内侧前缘
B. 外侧前缘
C. 内侧中线
D. 外侧后缘
E. 内侧后缘

正确答案：A。内侧前缘

解析：十二经脉左右对称地分布于头面、躯干和四肢，纵贯全身。与六脏相配属的六条阴经第十版针灸学（六阴经），分布于四肢内侧和胸腹，上肢内侧为手三阴经，下肢内侧为足三阴经；与六腑相配属的六条阳经第十版针灸学（六阳经），分布于四肢外側和头面、躯干，上肢外侧为手三阳经，下肢外侧为足三阳经。手足阳经为阳明在前（B错）、少阳在中、太阳在后（D错）；手足阴经为太阴在前（A对）、厥阴在中（C错）、少阴在后（E错）。